属于医疗保健机构提供婚前卫生咨询的是
A. 性卫生知识教育
B. 遗传病诊察
C. 传染病诊察
D. 心理健康指导
E. 对生育保健提供医学意见

正确答案：E。对生育保健提供医学意见

解析：本题考查医疗保健机构提供婚前的卫生咨询。医疗保健机构提供婚前卫生咨询，检查后，根据病史、体格检查、医技检查结果，对生育保健提供医学意见（E对ABCD错），如存在与婚育有关的异常情况或疾病时，主检医师在受检双方同意的情况下，向他们详细说明检查发现的异常情况可能产生的后果，并指导他们采取相应预防措施。